心脏骤停一旦确诊，应立即
A. 尝试捶击复律及清理呼吸道
B. 气管内插管
C. 人工呼吸
D. 口对口呼吸
E. 心脏按压

正确答案：E。心脏按压

解析：心脏骤停一旦确诊，首先进行的抢救措施是心肺复苏，心肺复苏程序现在修改为CAB，即人工胸外按压（C）-开通气道（A）-人工呼吸（B），故本题最佳答案为心脏按压（E对CD错）。捶击复律现已弃用（A错）。气管内插管（P318）（B错）是在初级心肺复苏的基础上进行的高级生命支持。